哪种刷牙方法最好
A. 轻刷
B. 重刷
C. 上下拂刷
D. 上下刷
E. 横刷

正确答案：C。上下拂刷

解析：本题考查刷牙方法。刷牙时简单的上下刷（D错）并不是有效的刷牙方法，上下拂刷（C对）才是最有效的刷牙方法，既有利于食物残渣的清除，又不会造成牙体硬组织的损害。刷牙时轻刷（A错）效果不好，食物残渣等不利于清除。刷牙时重刷（B错）对牙体硬组织损伤较大，时间长了容易导致牙齿磨损而产生敏感。刷牙时横刷（E错）对牙体硬组织损伤较大，时间长者会导致楔状缺损。